发表偏倚是指
A. 世界上几个主要的医学文献检索库绝大部分来自发达国家，发展中国家比例很小
B. 研究者往往根据需要自定一个纳入标准来决定某些研究的纳入与否
C. 有统计学意义的研究结果较无统计学意义的研究结果被报告和发表的可能性更大
D. 研究结果的筛选过程中筛选者主观意愿的影响而引入的偏倚
E. 只检索了某种语言的文献资料

正确答案：C。有统计学意义的研究结果较无统计学意义的研究结果被报告和发表的可能性更大